右心衰竭引起的缺氧其血氧变化特点是
A. 血氧容量降低
B. 动脉血氧含量降低
C. 动脉血氧饱和度降低
D. 动－静脉血氧含量差升高
E. 动－静脉血氧含量差降低

正确答案：D。动－静脉血氧含量差升高

解析：心力衰竭可以引起循环性缺氧，而血氧容量正常（A错）、动脉血氧含量正常（B错）、动脉血液饱和度正常（C错）、动-静脉血氧含量差升高（E错D对）是循环性缺氧的血氧变化特点。